黏肽指的是
A. 核糖体
B. 肽聚糖
C. 脂蛋白
D. 脂多糖
E. 异染颗粒

正确答案：B。肽聚糖

解析：肽聚糖或称作黏肽或胞壁质，为细胞壁的主要成分。掌握“细菌的大小、形态和基本结构”知识点。